结构中具有氨基甲酸酯片段，改善了药动学性质的β-内酰胺类抗生素是
A. 头孢氨苄
B. 氨苄西林
C. 头孢呋辛
D. 阿莫西林
E. 头孢曲松

正确答案：C。头孢呋辛

解析：本题考查抗感染药的性质和代谢。头孢呋辛（C对）C7位的氨基上连有顺式的α-甲氧肟基呋喃乙酰基侧链，甲氧肟基使药物对β-内酰胺酶有高度的稳定作用；C3位为氨基甲酸酯，改变药动学性质。